治疗肝脾不和，胸胁腹痛，四肢挛急，首选
A. 莪术
B. 当归
C. 益母草
D. 熟地黄
E. 白芍

正确答案：E。白芍

解析：白芍的功效为养血调经，敛阴止汗，柔肝止痛，平抑肝阳。其酸敛肝阴，养血柔肝而止痛，治疗血虚肝郁，胁肋疼痛，白芍亦可以调肝理脾，柔肝止痛；若阴血亏虚，筋脉失养而致手足挛急作痛，常配伍甘草缓急止痛。故治疗肝脾不和，胸胁腹痛，四肢挛急，应首选白芍（E对）。莪术功效破血行气，消积止痛（A错）。当归功效补血活血，调经止痛，润肠通便（B错）。益母草功效活血调经，利尿消肿，清热解毒（C错）。熟地黄功效补血滋阴，益精填髓（D错）。